选择性降低浦氏纤维自律性，缩短APD的药物
A. 利多卡因
B. 奎尼丁
C. 普鲁卡因胺
D. 普萘洛尔
E. 胺碘酮

正确答案：A。利多卡因